痛无定处，忽此忽彼，走注甚速多见于
A. 热痛
B. 寒痛
C. 风痛
D. 气痛
E. 湿痛

正确答案：C。风痛

解析：风痛：痛无定处，忽彼忽此，走注甚速，遇风则剧。见于行痹等（C对）。热痛：皮色掀红，灼热疼痛，遇冷则痛减。见于阳证疮疡（A错）。寒痛：皮色不红，不热，酸痛，得温则痛缓。见于脱疽、寒痹等（B错）。气痛：攻痛无常，时感抽掣，喜缓怒甚。见于乳癖等（D错）。湿痛：痛而酸胀，肢体沉重，按之出现可凹性水肿或见糜烂流滋。见于臁疮、股肿等（E错）。